Ⅰ度冻疮患者可以选用的非处方药是
A. 维A软膏
B. 樟脑软膏
C. 红霉素软膏
D. 杆菌肽软膏
E. 洗必泰软膏

正确答案：B。樟脑软膏

解析：本题考查冻伤治疗药。Ⅰ度冻疮患者可以选用的非处方药是樟脑软膏（B对）。Ⅰ度冻疮患者即轻度冻疮患者，可选用樟脑软膏、肌醇烟酸酯软膏等。维A软膏（A错）用于治疗寻常痤疮、黑头粉刺皮损，老年性、日光性或药物性皮肤萎缩，鱼鳞病及各种角化异常及色素过度沉着性皮肤病、银屑病。红霉素软膏（C错）用于溃烂、感染的冻疮，高锰酸钾清脓后使用。杆菌肽软膏（D错）用于脓疱疮等化脓性皮肤病及小面积烧烫伤和溃疡面的感染。